下列哪种药物中既有亲和力又有内在活性
A. 抗结核药
B. 激动药
C. 抗生素
D. 拮抗药
E. 抗真菌药

正确答案：B。激动药

解析：本题考查药物与受体、剂量与效应关系。激动药（B对）是既有亲和力又有内在活性的药物，它们能与受体结合并激动受体而产生效应。